急性下壁心肌梗死时心电图改变是
A. Ⅱ、Ⅲ、aVF病理性Q波及ST段上移
B. V₁～V₃病理性Q波及ST段上移
C. V₁～V₅病理性Q波及ST段上移
D. ⅠaVL病理性Q波及ST段上移
E. 心电图持续抬高达6个月以上

正确答案：A。Ⅱ、Ⅲ、aVF病理性Q波及ST段上移

解析：根据出现心肌梗死特征性心电图改变的导联可确定心肌梗死的部位和推测病变血管。急性下壁心肌梗死时心电图改变是ⅡⅢaVF病理性Q波及ST段上移（A对）。前间隔V₁～V₃病理性Q波及ST段上移（B错）。广泛前壁V₁～V₅病理性Q波及ST段上移（C错）。侧壁1aVL病理性Q波及ST段上移（D错）。心电图持续抬高达6个月以上提示心室室壁瘤（E错）。